下列为二级信息源的药学文献
A. 中国药学文摘
B. 药学杂志
C. 药物信息手册
D. 中国国家处方集
E. 中国基本药物处方集

正确答案：A。中国药学文摘

解析：本题考查药物信息的分类。二级信息源主要包括常见数据库如万方数据资源系统等，以及常见的国内外文摘如《中国药学文摘》（A对）等。期刊杂志（B错）是一级信息源。《药物信息手册》（C错）、《中国国家处方集》（D错）和《中国基本药物处方集》（E错）属于三级信息源。药学信息按照其最初来源通常分为三级：一级信息资源（一次文献）即原创性论著；二级信息资源（二级文献）是对原创性论著进行加工，主要用于检索一级文献，一般由引文书目组成，可提供摘要、引文、索引（包括或不包括全文）及目录；三级信息资源（三次文献）是在一级、二级文献的基础上归纳、综合、整理后的结果，包括医药图书（工具书、教科书、手册等）、光盘或在线数据库等。